阿司匹林的作用是
A. 抑制血小板聚集
B. 促进四氢叶酸类辅酶的循环利用
C. 抑制纤溶酶
D. 促进纤溶
E. 阻止凝血因子合成

正确答案：A。抑制血小板聚集

解析：本题考查阿司匹林的作用。阿司匹林的作用是抑制血小板聚集（A对）。阿司匹林为环氧酶抑制剂，能够抑制TXA₂诱导的血小板聚集。维生素B₁₂能够促进四氢叶酸类辅酶的循环利用（B错）。维生素K₁能够抑制纤溶酶（C错），从而促进凝血。溶栓药能够促进纤溶作用（D错）。维生素K拮抗剂可抑制维生素K在形成凝血因子过程中的作用从而抑制凝血因子的合成（E错）。